临床表现为咳嗽声重，痰稀色白的是
A. 风寒犯肺
B. 风热犯肺
C. 燥邪伤肺
D. 痰热壅肺
E. 肺肾阴虚

正确答案：A。风寒犯肺

解析：本题考查的是风寒犯肺证的临床表现。临床表现为咳嗽声重，痰稀色白的是风寒犯肺（A对）。风寒犯肺证的临床表现，常见咳嗽或气喘，咳痰稀薄，色白而多泡沫，口不渴，常伴有鼻流清涕，或发热恶寒，头痛身酸楚，舌苔薄白，脉浮或弦紧。风热犯肺（B错）证的临床表现，常见咳嗽，咳黄稠痰，不易咳出，甚则咳吐脓血臭痰，一般还伴咽喉疼痛、鼻流浊涕、口干欲饮等，舌尖红，脉浮数。病重者可见气喘鼻扇、烦躁不安。燥热犯肺（C错）证的临床表现，常见干咳无痰，或痰少而黏，缠喉难出，鼻燥咽干，舌尖红，苔薄白少津，脉浮细而数。并常伴有胸痛或发热头痛、身酸楚等症状。痰热壅肺（D错）证为喘证的辨证。喘证痰热壅肺证的临床表现为喘咳气涌，胸部胀痛，痰稠黏色黄，或夹血痰，伴胸中烦闷、身热、有汗、口渴喜冷饮、咽干、面红、尿赤、便秘。舌质红，苔薄黄腻，脉滑数。肺肾阴虚（E错）证的临床表现，常见咳嗽痰少，动则气促，间或咯血，腰膝酸软，消瘦，骨蒸潮热，盗汗遗精，颧红，舌红苔少，脉细数。